五脏共同的生理功能是
A. 贮藏津液
B. 贮藏气血
C. 贮藏血液
D. 贮藏精气
E. 贮藏水谷

正确答案：D。贮藏精气

解析：肾所藏先天之精，作为生命本原，在胎儿时期便贮藏于各脏腑之中，后天之精则经由脾肺等输送到各脏腑，化为各脏腑之精，并将部分输送于肾中，以充养肾所藏的先天之精，所以五脏都有贮藏精气的功能（D对）。